男，52岁。上腹间歇性隐痛10多年，近2个月疼痛加重，制酸药物不能缓解，食欲减退，消瘦。查体：贫血貌，右上腹有压痛。便隐血试验（﹢）。最可靠的诊断方法是
A. 大便反复隐血试验
B. 胃液分析
C. X线检查
D. 胃镜和活组织检查
E. 癌胚抗原测定

正确答案：D。胃镜和活组织检查

解析：本例患者为中年男性，有长期上腹间歇性隐痛病史，近2个月疼痛加重，制酸药物不能缓解，食欲减退，消瘦。查体：贫血貌，右上腹有压痛。便隐血试验（﹢），初步考虑可能是胃组织癌变，故最可靠的诊断方法是胃镜和活组织检查（D对）。大便反复隐血试验（A错）、胃液分析（B错）、X线检查（C错）、癌胚抗原测定（E错）对该患者疾病的诊断有一定意义，但不是最可靠的诊断方法。